若充填后出现悬突，则下列正确的处理措施为
A. 备牙后进行烤瓷冠的修复
B. 根管治疗
C. 牙周洁治
D. 去除充填物重新充填
E. 拔除

正确答案：D。去除充填物重新充填

解析：已出现有悬突时应及时去除；用细长砂石尖调磨，若不成功，应去除邻面充填物而重新充填。掌握“龋病治疗出现问题及处理”知识点。